糖皮质激素使用时间
A. 饭前
B. 上午7～8点
C. 睡前
D. 饭后
E. 清晨起床后

正确答案：B。上午7～8点

解析：本题考查糖皮质激素使用时间。肾上腺糖皮质激素分泌高峰出现在清晨，血药浓度在上午8时左右最高，且清晨服用可减少对下丘脑-垂体-肾上腺皮质系统的反馈抑制，避免导致肾上腺皮质功能下降，故其使用时间为上午7～8点（B对）；助消化药使用时间是饭前（A错）；催眠药使用时间是睡前（C错）。